太阳病，发汗未愈，风寒入里化热，身热不解，汗出而喘，舌苔薄白，脉滑数者，治疗应选用
A. 泻白散
B. 葛根黄芩黄连汤
C. 麻黄杏仁甘草石膏汤
D. 桂枝加厚朴杏子汤
E. 小青龙加石膏汤

正确答案：C。麻黄杏仁甘草石膏汤

解析：麻黄杏仁甘草石膏汤方证是表邪入里化热，壅遏于肺，肺失宣降所致。为治疗表邪未解，邪热壅肺之喘咳的基础方（C对）。泻白散主治肺有伏火郁热之证。为治疗肺热喘咳的常用方（A错）。葛根黄芩黄连汤方证是因伤寒表证未解，邪陷阳明所致。为治疗热泻、热痢的常用方（B错）。桂枝加厚朴杏子汤主治：宿有喘病，又感风寒而见桂枝汤证者（D错）。小青龙加石膏汤主治肺胀，心下有水气（E错）。